下壁、右心室心肌梗死患者应慎用的治疗是
A. 静脉滴注硝酸甘油
B. 口服氯吡格雷
C. 皮下注射低分子肝素
D. 口服阿托伐他汀
E. 口服阿司匹林

正确答案：A。静脉滴注硝酸甘油

解析：下壁、右心室心梗的患者，其主要改变是急性右心衰的血流动力学改变，右心房压力增高，高于左心室舒张末期压力，心排血量减低，血压下降，因此应扩张血容量，升高血压，而硝酸甘油（A对）主要通过扩张冠状动脉，增加冠状动脉血流量以及增加静脉血流而降低心脏前负荷而使血容量进一步下降，引发病情恶化。氯吡格雷（B错）属于ADP受体拮抗剂，作为抗血小板治疗，用于不能耐用阿司匹林的患者作为长期使用（九版药理学P268）。低分子肝素（C错）用于抗凝治疗（九版药理学P263）。阿托伐他汀（D错）用于调脂治疗、肾病综合征以及预防心血管急性事件（九版药理学P245）。阿司匹林（E错）是抗血小板药中应用最广泛的药物（九版药理学P266）。